足太阴脾经在胸部的循行为旁开前正中线
A. 0.5寸
B. 1.5寸
C. 2寸
D. 4寸
E. 6寸

正确答案：E。6寸

解析：该题考查十二经脉在躯干部的分布规律。循行与腹胸面的经脉，正中线为任脉，自内向外依次为足少阴肾经（距正中线在腹部为0.5寸，在胸部为2寸）（C错）、足阳明胃经（距正中线在胸部为4寸，经过乳头，在腹部为2寸）（C错）、足太阴脾经（距正中线在腹部为4寸，在胸部为6寸）（E对）,足太阴脾经，足厥阴肝经。ABD应为腹部旁开距离。记忆：在胸腹部由内向外依次是，任肾胃脾肝，趣记，人身为皮干。